女性，10岁。患儿在口腔检查时发现，右上Ⅳ缺失，缺牙间隙已明显缩小，拟采用哪种间隙保持器最为合适
A. 远中导板保持器
B. 丝圈保持器
C. 功能性活动保持器
D. 舌弓保持器
E. 间隙扩展装置

正确答案：E。间隙扩展装置

解析：本题考查间隙恢复装置的适应证。由于乳牙的龋损和早期丧失，引起牙列周长缩短，第一恒磨牙近中移位，这时必须推第一恒磨牙向远中移动，使第一恒磨牙回到正常位置，从而恢复丧失的间隙，间隙扩展装置（E对）可开扩间隙，利于恒牙的正常萌出，使邻牙保持在适当的位置。远中导板保持器（A错）适用于第二乳磨牙早失，第一恒磨牙尚未萌出或萌出中的病例。丝圈保持器（B错）适用于单侧第一乳磨牙早失或第一恒磨牙萌出后，第二乳磨牙单侧早期丧失的病例，亦或是双侧乳磨牙早失，用其他间隙保持器装置困难的病例。功能性活动保持器（C错）适用于乳磨牙缺失两个以上者，或两侧磨牙缺失，或伴有前牙缺失，它不仅能保持缺牙的近远中长度，还能保持垂直高度和恢复咀嚼功能，恢复因缺牙造成的语音功能障碍，改进和克服口腔不良习惯。舌弓保持器（D错）是将舌弓的两端固定在第二乳磨牙或第一恒磨牙上，以保持牙弓周长和牙齿间隙的保持器，是一种用于下颌的保持器。